治疗癃闭湿热下注证，应首选
A. 膀胱俞、中极、行间、内庭
B. 阴谷、肾俞、三焦俞、气海、委阳
C. 脾俞、胃俞、足三里、血海
D. 三阴交、阴陵泉、膀胱俞、中极
E. 关元、中极、足三里、肾俞

正确答案：D。三阴交、阴陵泉、膀胱俞、中极

解析：治疗癃闭湿热下注证，以毫针刺用泻法，本证由脾经湿热之邪，下注膀胱所致，膀胱为州都之官，气化所出，湿热蕴结，使膀胱气化失司，所以在分利脾经湿热的同时，取膀胱俞、中极，俞募配穴，以疏调下焦之气而利湿热。（D对）。行间、内庭可以清肝胃之热，却不能清脾经之热（A错）。此组穴位以培补肾气为主，可用于癃闭肾气不足证（B错）。脾俞、胃俞、足三里、血海以补益脾胃，补气养血为主，不适于湿热证（C错）。关元、足三里、肾俞以补益为主，湿热证不可再加补益（E错）。